住宅建设应遵循
A. 适用、经济、方便生活、美观的原则
B. 适用、经济、符合卫生要求的原则
C. 适用、经济、卫生、方便生活、美观的原则
D. 适用、经济、符合卫生要求、方便生活、美观的原则
E. 方便生活、卫生、美观的原则

正确答案：D。适用、经济、符合卫生要求、方便生活、美观的原则

解析：本题考查住宅建设应遵循的原则。住宅建设应遵循适用、经济、符合卫生要求、方便生活、美观的原则（D对ABCE错）。